蒙药的基本理论包括
A. 药物六味
B. 药物五元
C. 药物八性
D. 药物化味
E. 药物功能

正确答案：A、B、C、D、E。药物六味；药物五元；药物八性；药物化味；药物功能